半月板细胞含有的细胞是
A. 混合腺泡
B. 混合细胞以浆液为主
C. 浆液细胞
D. 黏液细胞
E. 混合细胞以黏液细胞为主

正确答案：C。浆液细胞

解析：本题考查浆液细胞的特点。半月板含有的细胞是浆液细胞（C对）。浆液细胞呈新月状位于腺泡的盲端表面，因此又称为半月板。